专家库不受行政区域的限制的是
A. 医生
B. 法医
C. 家属
D. 律师
E. 卫生行政部门工作人员

正确答案：B。法医

解析：负责组织医疗事故技术鉴定工作的医学会依照规定聘请医疗卫生专业技术人员和法医进入专家库，可以不受行政区域的限制。符合规定条件的医疗卫生专业技术人员和法医有义务进入专家库，并承担医疗事故技术鉴定工作。掌握“医疗事故的技术鉴定”知识点。